营养心脏本身的右冠状动脉，错误的描述是
A. 发自主动脉根部的主动脉右窦
B. 在右心耳与肺动脉根部之间穿出
C. 于冠状沟内向后，再下行达心尖
D. 沿途分为旋支和前降支
E. 分支营养右半心、窦房结和房室结

正确答案：D。沿途分为旋支和前降支

解析：右冠状动脉发自主动脉的主动脉右窦（A对）。在右心耳与肺动脉根部之间穿出（B对）。于冠状沟内向后，再下行达心尖（C对）。分为后室间支和右旋支（D错，为本题正确答案）。分支营养右半心、窦房结和房室结（E对）。